下述关于切牙乳头的叙述中哪项是错误的
A. 也称腭乳头
B. 位于腭中缝前端，左右上中切牙间之腭侧
C. 其深面为切牙孔，腭前神经、血管经此孔穿出
D. 组织致密，神经丰富
E. 阻滞麻醉时应从其侧缘刺入粘膜

正确答案：C。其深面为切牙孔，腭前神经、血管经此孔穿出

解析：切牙乳头（腭乳头）：位于腭中缝前端的黏膜隆起，其深面为切牙孔，鼻腭神经、血管经此孔穿出。掌握“腭、舌、舌下区的局部解剖”知识点。